琥珀宜
A. 先煎
B. 后下
C. 研末冲服
D. 包煎
E. 同煎

正确答案：C。研末冲服

解析：琥珀宜研末冲服（C对），这是由于琥珀为贵重药材，用量较轻，为防止散失，常需要研成细末制成散剂用温开水或复方其它药物煎液冲服。需先煎（A错）的药多为一些有效成分难溶于水的金石、矿物、介壳类药物，如磁石、代赭石、生铁落、生石膏、寒水石、紫石英、龙骨、牡蛎、海蛤壳、瓦楞子、珍珠母、石决明、紫贝齿、龟甲、鳖甲等。一些毒性较强的药物如附子、川乌、草乌等，也需先煎以降低毒性。需后下（B错）的药多为气味芳香的药物，久煎其有效成分易于挥发而降低药效，如薄荷、青蒿、砂仁、沉香、白豆蔻、草豆蔻等，此外一些中药的有效成分久煎会被破坏，这类中药也应后下，如钩藤、大黄、番泻叶。需包煎（D错）的药多为黏性强、粉末状及药材表面带有绒毛的药物，如蛤粉、滑石、旋覆花、车前子、蒲黄、灶心土等。同煎（E错）即为一般的煎煮方法，两味及两味以上药材共同煎煮。